属于体征的是
A. 心绞痛
B. 风湿性关节炎
C. 颈静脉怒张
D. 甲状腺功能亢进
E. 焦虑

正确答案：C。颈静脉怒张

解析：颈静脉怒张属于体征，体征即客观存在的异常表现，医师进行体格检查常可发现（C对）。心绞痛是疾病，可通过问诊来诊断（A错）。风湿性关节炎常累及膝、踝、肩和髋等四肢大关节，呈游走性疼痛，常在链球菌感染后出现，需通过辅助检查来明确诊断（B错）。甲状腺功能亢进需问诊、视诊、触诊结合来诊断（D错）。焦虑是症状（E错）。